咀嚼肌收缩所发挥的最大力是
A. 咀嚼效率
B. 咀嚼肌力
C. 最大（牙合）力
D. （牙合）力
E. 牙周潜力

正确答案：B。咀嚼肌力

解析：本题考查咀嚼肌力。咀嚼肌收缩所发挥的最大力是咀嚼肌力（B对）。1.咀嚼的主要功能之一是粉碎食物，使其能被吞咽和消化。机体在一定时间内，对定量食物嚼细的程度，称为咀嚼效率（A错）。咀嚼效率是咀嚼作用的实际效果，也是衡量咀嚼能力大小的一个重要生理指标。2.最大（牙合）力（C错）是指牙周膜的最大耐受力。3.上下颌牙咬合时，牙周组织所承受之力称为（牙合）力（D错）。在咀嚼时，咀嚼肌收缩力量若超过牙周膜的耐受阈，产生痛觉，通过反射而减少升颌肌群收缩力量，肌肉仅发挥部分的力量，并未用其全力。这种牙齿所承受的实际咀嚼力量，临床上称为咀嚼压力，亦称（牙合）力。4.牙周潜力（E错）是指在咀嚼各种食物时，并不需要很大的（牙合）力，而牙齿及牙周支持组织，尚有很大的潜力。